病例对照组研究中，若研究者对病例组调查和询问的态度认真，而对对照组漫不经心地调查询问以致错误结论，其中可能发生的偏倚是
A. 奈曼偏倚
B. 伯克森偏倚
C. 调查偏倚
D. 易感性偏倚

正确答案：C。调查偏倚

解析：本题考查调查偏倚。调查偏倚可能来自于调查者或调查对象。 病例与对照的调查环境与条件不同，或者调查者对病例与对照采取不同的询间方式（C对ABD错），或者对暴露测量方法、采用的仪器设备或试剂不统一、不准确等均可产生调查偏倚。